在下列氨基酸中酸性氨基酸是
A. 半胱氨酸
B. 脯氨酸
C. 色氨酸
D. 精氨酸
E. 谷氨酸

正确答案：E。谷氨酸

解析：本题考查氨基酸与多肽及蛋白质结构。带负电荷的R基氨基酸：天冬氨酸和谷氨酸（E对）都含有两个羧基，在生理条件下分子带负电荷，是一类酸性氨基酸。